诸燥狂越，皆属于
A. 火
B. 心
C. 风
D. 寒
E. 湿

正确答案：A。火

解析：诸躁狂越，皆属于火（A对）。诸痛痒疮，皆属于心（B错）。诸暴强直，皆属于风（C错）。诸病水液，澄澈清冷，皆属于寒（D错）。诸痉项强，皆属于湿（E错）。